能发现调查人群中的全部病例并给予及时治疗，或用作项目开发的依据是哪种调查方法的最大优点
A. 抽样调查
B. 普查
C. 捷径调查
D. 病例-对照研究
E. 群组研究

正确答案：B。普查

解析：本题考查普查的优点。能发现调查人群中的全部病例并给予及时治疗，或用作项目开发的依据是普查（B对）的最大优点。普查是指在特定时间范围内，一般为 1～2天或1～2周，对特定人群中的每一个成员进行的调查或检查，又称全面调查。抽样调查（A错）的优点是优点为：省时间、省劳力和省经费，且所得资料同样具有代表性。捷径调查（C错）的优点是经济实用，节省时间和人力。病例-对照研究（D错）的特点是观察时间短，需要研究的对象少。群组研究（E错）的特点是可以获得不同暴露强度和疾病的关系。